阿胶的功效是
A. 补血活血
B. 补血止血
C. 补血敛阴
D. 补血益精
E. 补血安神

正确答案：B。补血止血

解析：本题考查的是阿胶的功效。阿胶的功效是补血止血（B对）。阿胶：【功效】补血止血，滋阴润燥。当归：【功效】补血活血（A错），调经止痛，润肠通便。白芍：【功效】养血调经，敛阴（C错）止汗，柔肝止痛，平抑肝阳。何首乌：【功效】补益精血（D错），解毒，截疟，润肠通便。大枣：【功效】补中益气，养血安神（E错），缓和药性。